原发性慢性肾上腺皮质功能减退症患者肾上腺皮质对垂体反馈性抑制减弱的主要表现是
A. 疲乏无力、喜静少动、较淡漠
B. 食欲减退、恶心、喜咸食、体重减轻
C. 常感头晕、血压偏低、易有体位性低血压
D. 不耐饥饿、容易发生空腹低血糖
E. 皮肤、口腔颊黏膜和齿龈色素沉着

正确答案：E。皮肤、口腔颊黏膜和齿龈色素沉着